苯胺的代谢产物中，（）为强氧化剂，具有很强的形成高铁血红蛋白的能力
A. 对氨基酚
B. 苯醌
C. 硝基酚
D. 苯胲

正确答案：D。苯胲

解析：本题考查苯胺的毒理作用。苯胺的主要毒性作用是其中间代谢产物苯胲（D对ABC错），它有很强的形成高铁血红蛋白的能力，使血红蛋白失去携氧功能，造成机体组织缺氧，引起中枢神经系统、心血管系统及其他脏器的一系列损伤。另外红细胞内的珠蛋白变性形成赫恩滋小体，红细胞脆性增加，易产生溶血性贫血，继发肝、肾损伤。还可引起皮肤损伤。